关于我国孕产妇管理的说法，正确的是
A. 出院时保健手册应交给产妇
B. 确保婴儿安全的基础上保证孕妇安全
C. 产后3个月结束系统管理
D. 城市开展三级分工，农村开展二级分工
E. 妊娠3个月开始系统管理

正确答案：A。出院时保健手册应交给产妇

解析：手册应记录每次产前检查时的孕妇与胎儿情况及处理意见，在医院住院分娩时应提交孕产妇保健手册，出院时需将住院分娩及产后母婴情况填写完整后将手册交还给产妇，即出院时保健手册应交给产妇（A对），由产妇交至居住的基层医疗保健组织。孕妇系统管理是以母儿共同为监护对象（P133）（B错）。保健手册需从确诊早孕时开始建册（P133）（E错），系统管理直至产褥期结束（产后满6周）（C错）。（P133）现在我国城市开展医院三级管理，在农村也开展了三级管理（D错）。